某男性采矿工，年龄23岁，工作2年后参军。因主诉咳嗽、胸痛、气短等症状就诊。检查发现，X线胸片肺纹理增加，并伴有块状阴影和典型的结节，此位军人最可能患何种类型尘肺
A. 矽肺
B. 晚发性矽肺
C. 速发性矽肺
D. 煤肺
E. 铁肺

正确答案：B。晚发性矽肺

解析：本题考查晚发型矽肺概念。晚发型矽肺（B对ACDE错）是指有些接尘者，虽接触较高浓度矽尘，但在脱离粉尘作业时X线胸片未发现明显异常，或发现异常但尚不能诊断为矽肺，在脱离接尘作业若干年后被诊断为矽肺。本题中该男性曾有短暂的接触史，在一段时间后发病，呈现矽肺的症状和X线表现，符合晚发型矽肺的诊断条件。